类白血病反应的实验室检查特点是
A. 骨髄细胞内可见Auer小体
B. 中性粒细胞碱性磷酸酶积分增高
C. Ph染色体阳性
D. 糖原染色阳性
E. 非特异性酯酶染色阳性，可被NaF抑制

正确答案：B。中性粒细胞碱性磷酸酶积分增高

解析：类白血病反应的实验室检查特点有：粒细胞胞质常有中毒颗粒和空泡，嗜酸性粒细胞和嗜碱性粒细胞不增多，中性粒细胞碱性磷酸酶（NAP）反应强阳性（B对），Ph染色体（C错）及BCR-ABL融合基因阴性，血小板和血红蛋白多正常。骨髄细胞内可见Auer小体（A错）可见于急性非淋巴细胞白血病、RAEB-t型骨髓增生异常综合征；糖原染色阳性（D错）主要见于急性淋巴细胞白血病；非特异性酯酶染色阳性，可被NaF抑制（E错）仅见于急性单核细胞白血病。